根据《药品广告审查发布标准》，必须在广告中注明“本广告仅供医学药学专业人士阅读”的药品是
A. 氯雷他定片（OTC）
B. 艾司唑仑片
C. 阿奇霉素分散片
D. 曲马多片
E. 复方樟脑酊

正确答案：C。阿奇霉素分散片

解析：本题考查药品广告管理。根据《药品广告审查发布标准》，必须在广告中注明“本广告仅供医学药学专业人士阅读”的药品是阿奇霉素分散片（抗菌药）（C对）。药品广告的内容应当以国务院药品监督管理部门核准的说明书为准。药品广告涉及药品名称、药品适应症或者功能主治、药理作用等内容的，不得超出说明书范围。药品广告应当显著标明禁忌、不良反应，处方药广告还应当显著标明“本广告仅供医学药学专业人士阅读”，非处方药广告还应当显著标明非处方药标识（OTC）（A错）和“请按药品说明书或者在药师指导下购买和使用”。艾司唑仑片（B错）和曲马多片（D错）属于第二类精神药品；复方樟脑酊（医院制剂）（E错）为医院制剂，均不得发布广告。不得发布广告的产品：按照规定，不得做广告的产品包括：①麻醉药品、精神药品、医疗用毒性药品、放射性药品、药品类易制毒化学品，以及戒毒治疗的药品、医疗器械；②军队特需药品、军队医疗机构配制的制剂；③医疗机构配制的制剂；④依法停止或者禁止生产、销售或者使用的药品、医疗器械、保健食品和特殊医学用途配方食品；⑤法律、行政法规禁止发布广告的情形。